下列有关疫苗初种时间不正确的是
A. 乙肝疫苗为出生24小时
B. 卡介苗出生24小时
C. 麻疹疫苗出生1天
D. 白百破混合制剂出生3，4，5个月
E. 麻疹疫苗出生8个月

正确答案：C。麻疹疫苗出生1天

解析：乙肝疫苗接种的时间为出生（A对）、1月龄和6月龄。卡介苗初种为出生时（B对）。麻疹疫苗初种为八月龄（E对）（C错，为本题正确答案），百白破疫苗的时间为出生3、4、5月龄进行注射（D对）。简单记忆，出生乙肝卡介苗，二月脊灰炎正好，三四五百白破，八月麻疹和乙脑。